喙突位于
A. 锁骨
B. 肱骨
C. 尺骨
D. 桡骨
E. 肩胛骨

正确答案：E。肩胛骨

解析：肩胛上缘短而薄，外侧份有肩胛切迹，更外侧有向前的指状突起称喙突（E对）。